女婴，1天。足月产，出生1分钟Apgar评分3分。查体：P90次/分，R30次/分，嗜睡，面色微绀，前囟饱满，心音低钝，四肢肌张力减低，拥抱反射消失。最可能的诊断是
A. 胎粪吸入综合征
B. 新生儿败血症
C. 新生儿低血糖
D. 新生儿缺氧缺血性脑病
E. 新生儿肺透明膜病

正确答案：D。新生儿缺氧缺血性脑病

解析：本例患儿出生1天，出生1分钟Apgar评分3分，嗜睡（意识改变），面色微绀，前囟饱满（前囟张力增高），心音低钝，四肢肌张力减低（肌张力减弱），拥抱反射消失（原始反射异常），符合新生儿缺氧缺血性脑病诊断条件中的三条，最可能诊断为新生儿缺氧缺血性脑病（D对）。胎粪吸入综合征（P105）（A错）最主要临床表现为青紫，本例无青紫，排除胎粪吸入综合征。新生儿败血症（P122）（B错）早期症状一般不典型，本例出生1天，症状明显，排除新生儿败血症。新生儿低血糖（P134）（C错）大多无临床症状，排除新生儿低血糖。新生儿肺透明膜病（E错）出生后不久即出现进行性呼吸困难、青紫、呼气性呻吟、吸气性三凹征和呼吸衰竭，与本病例不符，排除新生儿肺透明膜病。